绕阴器的经脉是
A. 足厥阴经
B. 手厥阴经
C. 足少阴经
D. 手太阴经
E. 足太阴经

正确答案：A。足厥阴经

解析：该题考查十二经脉的循行，需理解记忆。